女，48岁。反复双手近端指间关节、膝关节痛伴晨僵2年，肘部伸侧可触及皮下结节，质硬无触痛。最有助于确定诊断的辅助检查是
A. 抗核抗体
B. 血沉
C. 血反应蛋白
D. 影像学
E. 血抗链球菌溶血“O”测定

正确答案：D。影像学

解析：X线片对RA诊断、关节病变分期及病情监测很重要，初诊至少应摄手指及腕关节的X线片（D对）。抗核抗体（A错）几乎见于所有的SLE，为SLE的最佳筛选实验。类风湿关节炎血沉（B错）和血反应蛋白（C错）异常见于多种疾病，缺乏特异性，对确定诊断价值不大。血清抗链球菌溶血素“0”（E错）滴度升高，提示近期内曾有过链球菌感染，类风湿关节炎与链球菌感染无关。